患者老年女性，68岁，心悸不宁，心烦少寐，头晕目眩，手足心热，盗汗，耳鸣，舌红，少苔，脉细数。应首选的治疗药物是
A. 三子养亲汤
B. 天王补心丹
C. 桂枝甘草龙骨牡蛎汤合金匮肾气丸
D. 人参养荣汤合桃红四物汤
E. 生脉散合酸枣仁汤

正确答案：B。天王补心丹

解析：患者禀赋不足，久病体虚，肾经亏耗都可导致肾阴不足，水火不济，虚火妄动，上扰心神，发为心悸。患者心阴虚，心失濡养，故见心悸；虚热扰心，神不守舍，故见心烦失眠；心肾阴血虚少，头目、耳窍、腰府失养，故见头晕目眩，耳鸣腰酸；阴血不足，虚热内生故见舌质红，少苔或无苔，脉细数。因此诊断为心悸的阴虚火旺证，代表方：天王补心丹（B对）。三子养亲汤治疗痰壅气滞食逆证（A错）。桂枝甘草龙骨牡蛎汤合金匮肾气丸治疗心肾阳虚证（C错）。人参养荣汤合桃红四物汤治疗气血两虚证（D错）。生脉散合酸枣仁汤治疗气阴两虚证（E错）。